帕金森病患者出现震颤麻痹是由于
A. 前庭小脑神经元病变所致
B. 红核神经元病变所致
C. 纹状体神经元病变所致
D. 多巴胺神经递质系统功能受损
E. 乙酰胆碱递质系统功能受损

正确答案：D。多巴胺神经递质系统功能受损

解析：帕金森病又称震颤麻痹，帕金森病病因是双侧黑质病变，多巴胺神经递质系统功能受损（D对B错）。黑质-纹状体多巴胺递质系统的作用在于抑制纹状体内乙酰胆碱递质系统，当黑质多巴胺神经元受损后，对纹状体内胆碱能神经元的抑制作用减弱（E错），导致乙酰胆碱功能亢进，进而影响新纹状体传出神经元的活动而引起一系列症状，因此，黑质多巴胺系统与纹状体乙酰胆碱系统之间的功能失衡可能是帕金森病的发病原因之一。纹状体神经元病变（C错）引起亨廷顿病。前庭小脑神经元病变（A错）使身体平衡失调，出现位置性眼震颤。